男性，27岁，左下后牙牙龈反复肿胀疼痛3个月，检查：35缺失，36近中倾斜，36、37间邻面接触关系不佳，该处牙龈肿胀，探诊易出血，探诊深度4mm，无自发出血现象。牙龈反复肿痛的原因最可能是
A. 血液性疾病
B. 食物嵌塞
C. 牙龈瘤
D. 增生性龈炎
E. 口呼吸

正确答案：B。食物嵌塞

解析：本题考查食物嵌塞诊断。患者男性，左下后牙牙龈反复肿胀疼痛3个月（牙龈疼痛肿胀），检查：35缺失，36近中倾斜，36、37间邻面接触关系不佳（病因），该处牙龈肿胀，探诊易出血（牙龈出血），探诊深度4mm（牙周袋），无自发出血现象，综合考虑可诊断由36、37间接触关系不良导致的食物嵌塞（B对）。食物嵌塞可引发牙龈和牙周的炎症 ，出现下列表征和症状：①两牙间发胀或有深隐痛；②牙龈发炎出血，局部有臭；③龈乳头退缩；④牙周袋形成和牙槽骨吸收，严重者可发生牙周脓肿；⑤牙周膜可有轻度炎症，导致牙齿咬合不适或叩诊不适；⑥根面齲。该病例未提示患者有血液性疾病（A错）和口呼吸（E错）。增生性龈炎（D错）主要是牙龈的炎性肿胀，多发生于青少年，一般不会形成牙周袋。牙龈瘤（C错）主要表现为牙龈乳头的球形或椭圆形肿块，不符合本病例的表现。